全身骨骼系统中变化最显著的部分是
A. 上颌骨的颧突
B. 下颌骨的髁突
C. 下颌骨的牙槽突
D. 腭骨的蝶突
E. 下颌骨的喙突

正确答案：C。下颌骨的牙槽突

解析：本题考查牙槽突。全身骨骼系统中变化最显著的部分是下颌骨的牙槽突（C对）。牙槽突的变化反映了骨组织的改建过程，是破骨与成骨两者相互平衡的生理过程，牙槽突的吸收在牙缺失后3个月最快，大约在6个月吸收率显著下降，拔牙后两年趋于稳定，为骨骼系统中变化最为显著的部分。